发出分支分布于食管腹段
A. 胃左动脉
B. 胃右动脉
C. 膈下动脉
D. 胃短动脉
E. 脾动脉

正确答案：A。胃左动脉

解析：胃左动脉（A对）发出分支分布于食管腹段、贲门和胃小弯附近的胃壁。